腹部损伤中最常受损的器官是
A. 肝
B. 胰腺
C. 肾
D. 胃
E. 脾

正确答案：E。脾

解析：脾位于左肋弓下缘，易受到外部暴力打击，且脾脏质地较脆，在外力的打击下容易破裂，尤其是已发生慢性损伤（如血吸虫病、疟疾、淋巴瘤等）的脾更易破裂。脾（E对）是腹部损伤中最常受损的器官，脾脏损伤约占全部腹部损伤的40～50%。腹部开放性损伤中常见的受损器官依次是肝（A错）、小肠、胃（D错）、结肠、大血管等；腹部闭合性损伤中常见的受损器官依次是脾、肾（C错）、小肠、肝、肠系膜等。胰腺（B错）、膈、十二指肠、直肠等由于解剖位置较深，损伤发生率较低。